干酪性肺炎的原因
A. 遗传性因索
B. 结核杆菌
C. 营养缺乏
D. 代谢因素
E. 食道静脉曲张破裂出血

正确答案：B。结核杆菌

解析：干酪性肺炎又称结核性大叶性肺炎，属于浸润性肺结核，在营养缺乏的条件下，由于机体抵抗力减弱，即使少量结核杆菌（B对）进入机体便可引起结核病。